属二蒽酮苷的是
A. 芦荟苷
B. 番泻苷A
C. 紫草素
D. 二氢丹参醌Ⅰ
E. 丹参素

正确答案：B。番泻苷A

解析：本题考查的是醌类化合物结构。属二蒽酮苷的是番泻苷A（B对）。醌类化合物从结构上分主要有苯醌、萘醌、菲醌、蒽醌等四类。1.苯醌类：苯醌类化合物从结构上可分为邻苯醌和对苯醌两大类。从中药软紫草中分得的一些物质属于对苯醌类化合物。2.萘醌类：许多萘醌类化合物具有明显的生物活性，如从中药紫草及软紫草中分得的一系列紫草素（C错）及异紫草素衍生物，可认为这些萘醌化合物为紫草的有效素成分。3.菲醌类：天然菲醌类衍生物包括邻醌及对醌两种类型。如从中药丹参根中提取得到多种菲醌衍生物，其中丹参醌Ⅰ（D错）、丹参醌ⅡA、丹参醌ⅡB、隐丹参醌、丹参酸甲酯、羟基丹参醌ⅡA等为邻醌类衍生物，而丹参新醌甲、丹参新醌乙、丹参新醌丙则为醌类化合物。4.蒽醌类：蒽醌类成分包括蒽酮及其不同还原程度的产物。按母核可分为单蒽核及双蒽核，按氧化程度又可分为氧化蒽酚、蒽酮、蒽酚及蒽酮的二聚物。如大黄、虎杖的致泻成分大黄酚；茜草中的茜草素及其苷、羟基茜草素、伪羟基茜草素；大黄、番泻叶的致泻成分番泻苷A（B错）、B、C、D等。芦荟苷（A错）是最早发现的结晶性蒽酮碳苷。丹参素（E错）为酚酸类化合物。